急性心肌梗死心肌坏死的心电图改变是
A. ST段下移
B. ST段明显上抬，呈弓背向上的单向曲线
C. T波倒置
D. T波高耸
E. 异常深而宽的Q波

正确答案：E。异常深而宽的Q波

解析：急性心肌梗死心肌坏死的心电图改变是异常深而宽的Q波（E对）。ST段明显上抬，呈弓背向上的单向曲线是急性心肌梗死心肌损伤的心电图改变（B错）；